右房肥大的心电图表现为
A. P波尖而高耸
B. P波低平
C. P波呈双峰状
D. P波增宽
E. P波出现切迹

正确答案：A。P波尖而高耸

解析：右房肥大的心电图表现为P波尖而高耸（A对），其振幅≥0.25mV，以Ⅱ、Ⅲ、aVF导联表现最为突出，又称“肺性P波”。这是因为当右心房肥大时，除极时间延长，往往与稍后除极的左心房时间重叠，故总的心房除极时间并未延长，心电图主要表现为心房除极波即P波振幅增高。P波低平（B错）主要见于心肌炎、心脏供血不足、或是情绪激动等。P波增宽（C错）、P波呈双峰状（D错）、P波出现切迹（E错）主要见于左心房肥大。